弥散性血管内凝血的特点，说法不正确的是
A. 某些致病因素作用下首先出现高凝状态
B. 血小板聚集、纤维蛋白沉淀
C. 广泛微血栓形成
D. 消耗性低凝状态出现
E. 血小板计数很高

正确答案：E。血小板计数很高

解析：DIC特点是在某些致病因素作用下，首先出现短暂的高凝状态、血小板聚集、纤维蛋白沉积、形成广泛的微血栓，继之出现消耗性低凝状态，并出现继发性纤维溶解亢进。而在一开始血栓形成之时，已经消耗了大量血小板，故血小板时候呈现进行性下降的。掌握“弥散性血管内凝血（DIC）”知识点。